以下哪项属于医德修养的方法
A. 积极参加医院的各种政治学习
B. 让领导多督促自己
C. 让同事多提醒自己
D. 让病人多监督自己
E. 追求慎独

正确答案：E。追求慎独

解析：医学道德修养的方法是自我反省、见贤思齐、坚持慎独。掌握“医学道德修养”知识点。